经肝脏羟化后的维生素D成为
A. 7-脱氢胆固醇
B. 维生素D₂
C. 维生素D₃
D. 25-羟维生素D₃
E. 1，25-二羟维生素D₃

正确答案：D。25-羟维生素D₃

解析：本题考查维生素D的相关内容。在人体内有两种形式的维生素D，维生素D₃（胆钙化醇）和维生素D₂（麦角钙化醇），维生素D在肝脏中通过羟基化作用转化成25-羟基维生素D₃（D对ABCE错），然后在肾脏中转换为具有活性的1，25-二羟基维生素D。